小分子的羟基萘醌类化合物具有
A. 酸性
B. 碱性
C. 升华性
D. 强氧化性
E. 与金属离子络合的性质

正确答案：A、C。酸性；升华性